下列属于成碱性食品的是
A. 谷类
B. 蛋类
C. 鱼类
D. 肉
E. 蔬菜和水果类

正确答案：E。蔬菜和水果类

解析：如蔬菜水果、豆类、海带等，进入人体后容易代谢出碱性物质，所以是碱性食物；食醋虽然味道酸，但在人体代谢过程中会产生二氧化碳和水，不会产生酸性物质，因此也属于碱性食物。
而如动物的肝脏、肉类、脂肪、蛋白质、五谷类食物含硫、磷、氯等阴离子较多，在人体内代谢后容易产生乳酸、磷酸等酸性物质，因此属于酸性食物。